石韦的原植物属于
A. 豆科
B. 水龙骨科
C. 柏科
D. 蔷薇科
E. 木兰科

正确答案：B。水龙骨科